猪苓的药用部位是
A. 干燥子实体
B. 干燥菌核
C. 干燥藻体
D. 干燥子座
E. 干燥菌丝体

正确答案：B。干燥菌核

解析：本题考查菌类中药的药用部位。猪苓的药用部位是干燥菌核（B对）。菌核由疏丝组织和拟薄壁组织组成的坚硬团块（核状体），如茯苓、猪苓。灵芝的药用部位是干燥子实体（A错）。子实体真菌（多是高等真菌）经过有性过程，形成能产生孢子的菌丝体结构，称子实体，如灵芝。子座（D错）是容纳子实体的菌丝褥座。子座形成后，常在其上或其内产生子实体。菌丝体（E错）组成一个真菌菌体的菌丝总称菌丝体。